实验设计中影响样本含量大小的因素为
A. α
B. 参数的允许误差
C. β
D. 总体标准差
E. 以上都是

正确答案：E。以上都是